身热夜甚，心烦失眠，神昏谵语，舌质绛，脉细数。应采用的治法是
A. 清热泻火法
B. 清热凉血法
C. 清热燥湿法
D. 清热解毒法
E. 清退虚热法

正确答案：B。清热凉血法

解析：本题考查治法清法的清热凉血法。应采用的治法是清热凉血法（B对）。清热凉血法：适用于热入营血证。症见身热夜甚，心烦失眠，神昏谵语。舌质绛，脉细数。清热泻火法：适用于气分实热证。症见壮热面赤，烦躁，口渴，汗出。舌红，苔黄，脉洪大有力。清热凉血法（A错）适用于热入营血证。症见身热夜甚，心烦失眠，神昏谵语。舌质绛，脉细数。清热燥湿法（C错）适用于湿热内蕴之证。由于湿热之邪所居部位不同，湿热证临床表现亦各具特点，如湿热蕴积胃肠所致泄泻、痢疾；湿热蕴结肝胆所致黄疸；湿热下注膀胱而致淋证；湿热蕴结下焦而致带下；湿热蕴积肌肤而致湿疹、湿疮等。清热解毒法（D错）适用于热毒壅盛之证。若三焦火毒热盛，可见身热烦躁，口燥咽干，错语不眠，脉数有力等；若热毒壅聚上焦中焦，可见身热口渴，面赤唇焦，胸膈烦热，口舌生疮，舌红，苔黄，脉滑数等；若热毒壅于上焦，可见头面红肿，腮颐肿大，咽喉肿痛等；若热毒壅结于肌肤，可见疮痈肿毒，局部红肿热痛；若热毒蕴于大肠，可见热毒泻痢，腹痛腹泻，里急后重，下利赤白，肛门灼热，舌红，苔黄，脉滑数等。清虚热法（E错）适用于阴虚发热证。症见午后或夜间发热，手足心热，或骨蒸潮热，心烦少寐，颧红，盗汗，口干咽燥。舌红，少苔，脉细数。